中年，男性，不慎跌倒摔伤右肩。以左手托右肘部来诊。头向右倾，检体见右肩下沉，右上肢功能障碍。胸骨柄至右肩峰连线中点隆起，并有压痛，其可能的诊断是
A. 肩关节脱位
B. 锁骨骨折
C. 肱骨外科颈骨折
D. 肩胛骨骨折
E. 肱骨解剖颈骨折

正确答案：B。锁骨骨折

解析：患者右肩摔伤，以左手托右肘部、头向右倾、右肩下沉（锁骨骨折典型表现），胸骨柄至右肩峰连线中点隆起、压痛，结合患者临床表现和体查，其可能的诊断是锁骨骨折（B对）。肩关节脱位（P631）（A错）的典型表现为方肩畸形、肩胛盂处空虚、上肢弹性固定及Dugas征阳性（即将患侧肘部紧贴胸壁时，手掌搭不到健侧肩部，或手掌搭在健侧肩部时，肘部无法贴近胸壁）。肱骨外科颈骨折（P632）（C错）和肱骨解剖颈骨折（E错）均属于肱骨近端骨折，一般无典型体征，需要结合病史、X线和CT检查确诊。肩胛骨骨折（D错）常由强大暴力所引起，发病率较低，主要表现为肿胀、疼痛、关节活动受限和肌肉痉挛，需辅助检查确诊。